下列药物中，需进行血药浓度监测的是
A. 治疗指数小的药物
B. 具有非线性动力学特征的药物
C. 毒性反应强的药物
D. 吸收较快的药物
E. 个体差异很大的药物

正确答案：A、B、C、E。治疗指数小的药物；具有非线性动力学特征的药物；毒性反应强的药物；个体差异很大的药物

解析：本题考查治疗药物检测的范围。需要进行血药浓度监测的包括：1.个体差异很大的药物（E对）；2.具非线性动力学特征的药物（B对）；3.治疗指数小（A对）、毒性反应强（C对）的药物。